片剂的崩解剂
A. 聚乙烯吡咯烷酮溶液
B. L-羟丙基纤维素
C. 乳糖
D. 乙醇
E. 聚乙二醇6000

正确答案：B。L-羟丙基纤维素

解析：本题考查片剂的常用辅料。崩解剂系指促使片剂在胃肠液中迅速破裂成细小颗粒的辅料。常用的崩解剂有：干淀粉、羧甲基淀粉钠（CMS-Na）、低取代羟丙基纤维素（B对）、交联羧甲基纤维素钠（CCMC-Na）、交联聚维酮（PVPP）和泡腾崩解剂（碳酸氢钠和枸橼酸组成的混合物，也可以用柠檬酸、富马酸与碳酸钠、碳酸钾、碳酸氢钾）等。聚乙烯吡咯烷酮溶液（A错）为黏合剂。乳糖（C错）为填充剂。乙醇（D错）为润湿剂。聚乙二醇6000（E错）常作为润滑剂、分散剂、赋型剂等。